下列不属于人类自然杀伤细胞的表型是
A. TCR-
B. mIg-
C. CD56+
D. CD16+
E. CD88+

正确答案：E。CD88+

解析：人类自然杀伤细胞的表面标志是：TCR-、mIg-、CD56+、CD16+。掌握“NK细胞、抗原提呈及其他免疫细胞”知识点。